四肢肌肉的壮实主要取决于
A. 心主血脉
B. 肺主气
C. 脾主运化
D. 肝主筋
E. 肾藏精

正确答案：C。脾主运化

解析：全身肌肉赖脾胃运化的水谷精微的营养滋润，才能壮实丰满，并发挥其运动机能。（C对）。